治疗经行头痛血瘀证，应首选
A. 丹栀逍遥散
B. 通窍活血汤
C. 乌药汤
D. 天仙藤散
E. 龙胆泻肝丸

正确答案：B。通窍活血汤

解析：经行头痛血瘀证的病机是瘀血阻滞脑络，脉络不通，不通则痛，治疗应化瘀通络，方用活血化瘀，通窍活络之通窍活血汤（B对）。丹栀逍遥散（A错）主治肝郁血虚内热证；乌药汤（C错）主治经行腹痛；天仙藤散（D错）主治子肿气滞证；龙胆泻肝丸（E错）主治肝经实火上炎及肝经湿热下注。